茎方柱形，节稍膨大，叶柄短，叶片皱缩，整理展平后呈披针或卵状披针形，上表面绿色，下表面灰绿色，二面光滑，味极苦的药材是
A. 青蒿
B. 穿心莲
C. 半枝莲
D. 广藿香
E. 绵茵陈

正确答案：B。穿心莲

解析：本题考查的是穿心莲药材的鉴别。茎方柱形，节稍膨大，叶柄短，叶片皱缩，整理展平后呈披针或卵状披针形，上表面绿色，下表面灰绿色，二面光滑，味极苦的药材是穿心莲（B对）。穿心莲：【性状鉴别】药材茎呈方柱形，多分枝，节稍膨大；质脆，易折断。单叶对生，叶柄短或近无柄；叶片皱缩、易碎，完整者展开后呈披针形或卵状披针形，先端渐尖，基部楔形下延，全缘或波状；上表面绿色，下表面灰绿色，两面光滑。气微，味极苦。青蒿（A错）：【性状鉴别】茎呈圆柱形，上部多分枝；表面黄绿色或棕黄色，具纵棱线；质略硬，易折断，断面中部有髓。叶互生，暗绿色或棕绿色，卷缩易碎，完整者展平后为三回羽状深裂，裂片及小裂片矩圆形或长椭圆形，两面被短毛。气香特异，味微苦。半枝莲（C错）：【性状鉴别】药材无毛或花轴上疏被毛。根纤细。茎丛生，较细，方柱形；表面暗紫色或棕绿色；叶对生，有短柄；叶片多皱缩，展平后呈三角状卵形或披针形；先端钝，基部宽楔形，全缘或有少数不明显的钝齿；上表面暗绿色，下表面灰绿色。花单生于茎枝上部叶腋，花萼裂片钝或较圆；花冠二唇形，棕黄色或浅蓝紫色，被毛。果实扁球形，浅棕色。气微，味微苦。广藿香（D错）：【性状鉴别】药材茎略呈方柱形，多分枝，枝条稍曲折；表面被柔毛；质脆，易折断，断面中部有髓；老茎类圆柱形，被灰褐色栓皮。叶对生，皱缩成团，展平后叶片呈卵形或椭圆形；两面均被灰白色绒毛；先端短尖或钝圆，基部楔形或钝圆，边缘具大小不规则的钝齿；叶柄细，被柔毛。气香特异，味微苦。茵陈：【性状鉴别】药材绵茵陈（E错）多弯曲成团状，灰白色或灰绿色，全体密被白色茸毛，绵软如绒。茎细小，除去表面白色茸毛后可见明显纵纹；质脆，易折断。叶具柄；展平后叶片呈一至三回羽状分裂；小裂片卵形或稍呈倒披针形、条形，先端尖锐。气清香，味微苦。